一次性使用输液器的包装上，不需注明
A. 无菌
B. 无热原
C. 一次性使用
D. 失效日期
E. 润滑剂的名称

正确答案：E。润滑剂的名称